与CD4分子结合的配体是
A. MHCⅠ类分子
B. MHCⅡ类分子
C. MHCⅢ类分子
D. TCR
E. BCR

正确答案：B。MHCⅡ类分子